甘麦大枣汤除养心安神，和中缓急外，还具有的功用是
A. 补心血
B. 补脾气
C. 益肝血
D. 滋肾水
E. 益脾阴

正确答案：B。补脾气

解析：方中大枣补脾益气，缓肝急并治心虚（B对）。记忆：金匮甘麦大枣汤，妇人脏躁喜忧伤，精神恍惚常欲哭，养心安神效力彰。